控制感染的基本特点为
A. 防止血源性以及非血源性疾病的传播
B. 强调双向防护
C. 采取接触隔离
D. 采取空气隔离
E. 以上均正确

正确答案：E。以上均正确

解析：控制感染应遵循标准预防的原则，其基本特点为：①既要防止血源性疾病的传播，也要防止非血源性疾病的传播；②强调双向防护，既防止疾病从患者传至医务人员，又防止疾病从医务人员传至患者；③根据疾病的主要传播途径，采取相应的隔离措施，包括接触隔离、空气隔离和微粒隔离。掌握“患者、医务人员及环境的防护”知识点。